罗红霉素是
A. 红霉素C-9腙的衍生物
B. 红霉素C-9肟的衍生物
C. 红霉素C-6甲氧基的衍生物
D. 红霉素琥珀酸乙酯的衍生物
E. 红霉素扩环重排的衍生物

正确答案：B。红霉素C-9肟的衍生物

解析：本题考查罗红霉素。罗红霉素是红霉素C-9肟的衍生物（B对）。红霉素C-9腙的衍生物（A错）是红霉素胺。红霉素C-6甲氧基的衍生物（C错）是克拉霉素。红霉素琥珀酸乙酯的衍生物（D错）是琥乙红霉素。红霉素扩环重排的衍生物（E错）是阿奇霉素。